严重缺氧
A. 内源性凝血系统被激活
B. 外源性凝血系统被激活
C. 两者均有
D. 两者均无
E. 无

正确答案：B。外源性凝血系统被激活

解析：外源性凝血系统被激活（B对ACDE错）出现在严重缺氧时，损伤血管内皮细胞，损伤的血管内皮细胞释放组织因子，启动外源性凝血系统。